干咳少痰，久咳不愈，应考虑是
A. 外感风热
B. 外感风寒
C. 阴虚肺燥
D. 百日咳
E. 咽炎

正确答案：C。阴虚肺燥

解析：本病例以咳嗽为主要症状，中医诊断为咳嗽，久咳提示病程久，故属于内伤咳嗽。小儿咳嗽，日久不愈，正虚邪恋，热伤肺络，或素体阴虚，肺失濡润，而久咳不止，干咳无痰，声音嘶哑，故应考虑阴虚肺燥（C对）。外感风热（A错）咳嗽其临床表现为咳痰不爽，痰黄黏稠，不易咯出。外感风寒（B错）咳嗽其临床表现为咳嗽频作，咳声重浊。百日咳（D错）临床表现为咳嗽逐渐加重，呈典型的阵发性、痉挛性咳嗽，咳嗽终末出现深长的鸡啼样吸气性吼声。咽炎（E错）主要表现为咽部有异物感，咯不出，咽不下。